某女性患者，38岁。牙龈自发性出血1年半就诊。检查：舌缘、两颊黏膜多处瘀斑，患者自述平时轻微碰撞皮肤即会出现瘀斑。血常规检查：血小板计数30×10⁹/L。治疗该病的首选药是
A. 青霉素
B. 红霉素
C. 干扰素
D. 泼尼松
E. 肾上腺素

正确答案：D。泼尼松

解析：本题考查血小板减少性紫癜的治疗。某女性患者，38岁。牙龈自发性出血1年半就诊。检查：舌缘、两颊黏膜多处瘀斑，患者自述平时轻微碰撞皮肤即会出现瘀斑。血常规检查：血小板计数30×10⁹/L。考虑诊断为血小板减少性紫癜。治疗该病的首选药是泼尼松（D对）。青霉素（A错）主要用于治疗敏感的G+球菌和杆菌、G-球菌及螺旋体所致感染。红霉素（B错）常用于治疗耐青霉素的金黄色葡萄球菌感染和对青霉素过敏者，也能用于厌氧菌引起的口腔感染和肺炎支原体、肺炎衣原体、溶脲脲原体等非典型病原体所致的呼吸系统、泌尿生殖系统感染。干扰素（C错）对感冒、乙型肝炎、带状疱疹和腺病毒性角膜炎等感染有预防作用；已试用于人肿瘤的治疗，对成骨肉瘤患者的疗效较好，对其他肿瘤（如多发性骨髓瘤、乳癌、肝癌、肺癌、各种白血病）也具有一定的临床辅助疗效，可改善患者的血象和全身症状。肾上腺素（E错）主要激动α和β受体，可用于心脏骤停、过敏性休克、支气管哮喘、血管神经性水肿及血清病等过敏性疾病，也可局部应用止血及治疗青光眼。